患者，女性，55岁。20年来因丈夫有外遇，夫妻感情不佳，总想离婚，但舍不得孩子，又怕丢面子，来到心理咨询门诊，想咨询离婚还是不离婚好。此时心理咨询师应注意采用的原则是
A. 回避原则
B. 中立原则
C. 耐心原则
D. 综合原则
E. 灵活原则

正确答案：B。中立原则